脾破裂
A. 左肩放射性痛
B. 尿淀粉酶升高
C. 膈下游离气体
D. 腹膜后积气
E. 腹部外伤后直肠指检指套染血

正确答案：A。左肩放射性痛

解析：脾破裂时可出现左肩放射痛（A对）。尿淀粉酶（B错）升高多见于急性胰腺炎；膈下游离气体（C错）见于消化道穿孔；腹膜后积气（D错）见于十二指肠损伤；直肠破裂可出现腹部外伤后直肠指检指套染血（E错）。